可引起尖端扭转性室性心动过速的药物是
A. 阿司匹林
B. 磺胺甲噁唑
C. 卡托普利
D. 奎尼丁
E. 两性霉素B

正确答案：D。奎尼丁

解析：本题考查药源性疾病。可引起尖端扭转性室性心动过速的药物是奎尼丁（D对）；阿司匹林（A错）大剂量可导致外周血管扩张，中毒剂量可抑制循环功能；磺胺甲噁唑（B错）可引起Steven-Johnson综合征和中毒性表皮坏死；卡托普利（C错）可引起肾功能损害、肾病综合征、肾小球肾炎等；两性霉素B（E错）可引起急性肾小管坏死。